格列齐特的不良反应是
A. 诱发、加重青光眼
B. 易发生低血糖反应
C. 诱发哮喘、加重心衰
D. 导致出大汗、发生虚脱
E. 导致脱水、低血钾、电解质紊乱

正确答案：B。易发生低血糖反应

解析：本题考查格列齐特的不良反应。格列齐特的不良反应是易发生低血糖反应（B对）。格列齐特属于磺酰脲类第二代口服降糖药，作用时间长，持续12～24小时，易在体内蓄积，发生低血糖。